千金子源于大戟科，属温性峻下逐水药，其主治病证不包括
A. 水肿
B. 癥瘕
C. 顽癣
D. 毒蛇咬伤
E. 寒痰咳喘

正确答案：E。寒痰咳喘

解析：本题考查的是千金子的主治病证。千金子源于大戟科，属温性峻下逐水药，其主治病证不包括寒痰咳喘（E错，为本题正确答案）。千金子：【主治病证】（1）水肿（A对），鼓胀。（2）癥瘕（B对），闭经。（3）顽癣（C对），赘疣，毒蛇咬伤（D对）。寒痰咳喘为芫花的主治病证。芫花：【主治病证】（1）身面浮肿，大腹水肿，胸胁停饮。（2）寒痰咳喘。（3）头疮，白秃，顽癣，冻疮。